引发下肢丹毒的致病菌是
A. 金黄色葡萄球菌
B. 乙型溶血性链球菌
C. 克雷伯杆菌
D. 结核分枝杆菌
E. 大肠埃希菌

正确答案：B。乙型溶血性链球菌

解析：引发下肢丹毒的致病菌是乙型溶血性链球菌（B对）。